餐时血糖显著升高患者宜选用
A. 胰岛素
B. 二甲双胍
C. 格列喹酮
D. 瑞格列奈
E. 阿卡波糖

正确答案：D。瑞格列奈

解析：本题考查糖尿病的治疗。瑞格列奈（D对）为非磺酰胺类降糖药，非磺酰胺类降糖药诱发胰岛素分泌，降糖作用快，其快速释放有快速关闭，对餐时、餐后血糖有显著控制作用。